下述正确描述阑尾的是
A. 开口于盲肠后内侧壁
B. 为腹膜内位器官
C. 有一三角形系膜
D. 位置以盲肠后位最多见
E. 以上全对

正确答案：E。以上全对

解析：阑尾开口于盲肠后内侧壁(A对)回盲口下方约2cm，为腹膜内位器官(B对)，阑尾系膜一般为三角形系膜(C对)，阑尾以回肠下位和盲肠后位较为多见(D对，E为本题正确答案)。